药品零售企业应当执行
A. 《药品生产质量管理规范》
B. 《药品经营质量管理规范》
C. 《中药材生产质量管理规范》
D. 《药物临床试验质量管理规范》
E. 《优良药房工作规范》

正确答案：B。《药品经营质量管理规范》

解析：本题考查的是药品零售企业的开办条件。药品零售企业应当执行《药品经营质量管理规范》（B对）。药品零售企业（含药品零售连锁门店）的开办条件：从事药品零售活动，应当具备以下条件：（1）经营处方药、甲类非处方药的，应当按规定配备执业药师或者其他依法经过资格认定的药学技术人员；经营乙类非处方药的，应当根据省、自治区、直辖市药品监督管理部门的规定配备药学技术人员；企业法定代表人、主要负责人、质量管理负责人（以下称质量负责人）无《药品管理法》规定的禁止从事药品经营活动的情形。（2）具有与所经营药品相适应的营业场所、设备、计算机系统、陈列（仓储）设施设备以及卫生环境；在超市等其他场所从事药品零售活动的，应当具有独立的经营区域。（3）具有独立的计算机管理信息系统，能覆盖企业药品经营和质量控制全过程，并实现药品信息化追溯。（4）具有保证药品质量的规章制度，并符合药品GSP的要求。从事药品生产活动，应当遵守药品生产质量管理规范，建立健全药品生产质量管理体系，保证药品生产全过程持续符合法定要求。按照新《药品管理法》发布实施之前的规定，新开办药品生产企业或药品生产企业新增生产范围、新建车间的，应当按照《药品管理法实施条例》的规定，自取得生产证明文件或经批准正式生产之日起30日，按照规定要求申请药品《药品生产质量管理规范》（A错）（GMP）认证。《中药材生产质量管理规范》（C错）（GAP）是中药材生产和质量管理的基本准则，适用于中药材生产企业生产中药材（含植物、动物药）的全过程。《药物临床试验质量管理规范》（D错）（GCP）：药物临床试验包括新药临床试验（含生物等效性试验）和上市后的Ⅳ期临床试验。为保证药物研究实验记录真实、及时、准确、完整，提高药物临床试验质量，保障受试者的合法权益，药物临床试验实行过程管理；药物临床试验必须实施《药物临床试验质量管理规范》；并执行《药品研究实验记录暂行规定》《药品临床研究若干规定》等相关规定。《优良药房工作规范》（E错），2020年考试指南未明确说明。